与迷走神经相关联的核团是
A. 副神经核
B. 下泌涎核
C. 下橄榄核
D. 三叉神经脑桥核
E. 动眼神经核

正确答案：A。副神经核

解析：副神经核（A对）接受双侧皮质核束纤维的传入，其延髓部发出的纤维构成副神经的脑根，最终加入迷走神经，支配咽喉肌；下泌涎核（B错）发出副交感神经的节前纤维进入 舌咽神经，经其分支岩小神经至耳神经节换元，节后纤维管理腮腺的分泌；下橄榄核（C错）可能是大脑皮质、红核等与小脑之间纤维联 系的重要中继站，参与小脑对运动的调控；三叉神经脑桥核（D错）主要接受经三叉神经传入的头面部触、压觉初级纤维 。 还接受来自 三叉神经中脑核的纤维；动眼神经核（E错）节发出副交感神经节后纤维支配睫状肌和瞳孔括约肌的收缩，以调节晶状体的曲度和缩小瞳孔。